适用于高血压合并糖尿病、肾损害患者的药物是
A. 缬沙坦
B. 美托洛尔
C. 非洛地平
D. 氢氯噻嗪
E. 赖诺普利

正确答案：E。赖诺普利

解析：本题考查抗高血压药。适用于高血压合并糖尿病、肾损害患者的药物是赖诺普利（E对）。抗高血压药物的选用：①利尿剂：如氢氯噻嗪（D错），适用于一、二级高血压，尤其是老年高血压或并发心力衰竭者，但痛风患者禁用，糖尿病和高脂血症患者慎用。②β受体阻断药：如美托洛尔（B错），适用于一、二级高血压，尤其适用于静息时心率较快的中青年患者合并心绞痛者。心脏传导阻滞、哮喘、慢性阻塞性肺病与周围血管病患者禁用。2型糖尿病患者慎用。③钙拮抗药。④血管紧张素转换酶抑制剂（ACEI）：如赖诺普利，适用于高血压合并糖尿病，或者并发左心功能不全、肾损害有蛋白尿的患者。妊娠和肾动脉狭窄者禁用。